深龋和慢性牙髓炎的主要鉴别点是
A. 刺激痛的强弱
B. 有无自发痛史
C. 自发痛的剧烈程度
D. 自发痛能否定位

正确答案：B。有无自发痛史

解析：本题考查深龋和慢性牙髓炎的鉴别。深龋无自发痛史，只有温度进入龋洞内时才出现敏感症状，慢性牙髓炎有自发痛史，因此有无自发痛史（B对CD错）是深龋与慢性牙髓炎的主要鉴别点。深龋温度进入洞内时出现敏感症状，刺激去除后症状立即消失，刺激未进入龋洞内对温度反应与对照牙相同，慢性牙髓炎对温度刺激引起的疼痛反应会持续一段时间，龋病和慢性牙髓炎的疼痛反应情况不同，但刺激痛的强弱相似（A错）。